正常菌群对机体的生理学作用不包括
A. 生物拮抗
B. 营养作用
C. 免疫作用
D. 抗衰老作用
E. 协同作用

正确答案：E。协同作用